下列情况不易导致医患交往障碍的是
A. 医生对病人的病痛缺乏应有的同情和责任感
B. 以对方能否带来物质利益而确定关系的好坏
C. 病人情绪不稳，容易激惹，反应敏感
D. 病人过分挑剔或过分冷淡
E. 医生耐心解释病情

正确答案：E。医生耐心解释病情

解析：影响医患关系的因素有很多，包括医患之间缺乏信任和理解，部分医生更多考虑医疗机构和自身的利益，以及病人本身对医生的缺乏理解，不了解医学和疾病的复杂性等。但医生耐心解释病情不会导致医患交往困难。掌握“医患关系概述及医患交往的形式和水平”知识点。